右肺
A. 分上、中、下3叶
B. 最高处不超过胸廓上口
C. 前缘有肺小舌
D. 比左肺狭长
E. 无

正确答案：A。分上、中、下3叶

解析：斜裂和水平裂将右肺分为上上、中、下3叶（A对）。肺尖经胸廓上口突入颈根部（B错）。左肺前缘有肺小舌，右肺没有（C错）。左肺比右肺狭长（D错）。